栓剂中的水溶性基质
A. PVP
B. PEG
C. A和B均用
D. A和B均不用

正确答案：B。PEG

解析：本题考查栓剂的基质。PEG（聚乙二醇）（B对）为栓剂中的水溶性基质；聚维酮（PVP）是水溶性的合成聚合物,主要成分为N-乙烯吡咯烷酮，具有高效粘合性,主要作为固体制剂湿法制粒的粘合剂，不可用作栓剂水溶性基质（ACD错）。